环孢素测定血药谷浓度的时间是
A. 肾脏毒性
B. 服药后2小时
C. 心脏毒性
D. 服药后8小时
E. 早晨服药前

正确答案：E。早晨服药前

解析：本题考查环孢素的代谢。环孢素测定血药谷浓度的时间是早晨服药前（E对）。